患者，男，75岁，1个月前诊断为阿尔茨海默病，口服多奈哌齐治疗。关于该患者教育的说法，错误的是
A. 出现兴奋症状时，应尽早使用抗精神病药物
B. 长期使用多奈哌齐需评估对患者体重的影响
C. 在给予患者必要看护的前提下，鼓励其尽量独立完成日常活动
D. 多奈哌齐仅能改善症状，并不能改变疾病的进程和结局
E. 多奈哌齐用药过程中，注意监测心率

正确答案：A。出现兴奋症状时，应尽早使用抗精神病药物

解析：本题考查阿尔茨海默病。阿尔茨海默病出现兴奋性症状时不建议使用抗精神病药物（A错，为本题正确答案），与安慰剂组相比，抗精神病药物增加了痴呆患者的死亡风险。多奈哌齐仅能改善症状，并不能改变疾病的进程和结局（D对）。长期使用多奈哌齐需评估对患者体重的影响（B对）。多奈哌齐用药前查心电图，注意血压和心律、心率（E对）。阿尔茨海默病改善功能措施：（1）改变行为方式：定时如厕，对尿失禁患者定时提醒排尿；（2）分级护理支持：对日常活动尽可能不予帮助，只给予必要的看护，以提高患者的独立性（C对）。